治疗肝性脑病、慢性迁延性肝炎、慢性活动性肝炎引起的氨基酸代谢紊乱的药物是
A. 赖氨酸注射液
B. 复方氨基酸注射液（18AA）
C. 复方氨基酸注射液（9AA）
D. 丙氨酰谷氨酰胺注射液
E. 复方氨基酸注射液（6AA）

正确答案：E。复方氨基酸注射液（6AA）

解析：本题考查氨基酸的分类。复方氨基酸注射液（6AA）（E对）、复方氨基酸注射液（15AA）、复方氨基酸注射液（20AA）是可用于肝病的氨基酸制剂。赖氨酸注射液（A错）是用于颅脑损伤的氨基酸制剂。复方氨基酸注射液（18AA）（B错）是平衡型氨基酸制剂。复方氨基酸注射液（9AA）（C错）是用于肾病的氨基酸制剂。丙氨酰谷氨酰胺注射液（D错）是免疫调节型氨基酸注射液。